黏附于髓室壁的是
A. 弥散性钙化
B. 髓石
C. 牙髓炎
D. 根尖周炎
E. 牙髓息肉

正确答案：B。髓石

解析：本题考查牙髓病。黏附于髓室壁的是髓石（B对）。髓石或游离于牙髓组织中，或附着在髓腔壁上。